男，21岁。畏寒，高热，咳嗽伴左胸痛5天。查体：BP80/50mmHg，心率120次/分。胸部X线片见左肺下叶大片状致密影。实验室检查：血WBC12.2×10⁹/L，N0.87。该患者最可能感染的病原体是
A. 肺炎支原体
B. 肺炎链球菌
C. 军团菌
D. 金黄色葡萄糖球菌
E. 结核分枝杆菌

正确答案：B。肺炎链球菌

解析：患者为青年男性（肺炎链球菌肺炎的好发年龄），有畏寒、高热、胸痛（为肺炎的典型症状），血WBC12×10⁹/L（正常为4～10×10⁹/L），N0.87（正常值为0.50～0.70），提示存在感染，X线片示大片状致密影，根据其临床表现和体征，符合链球菌肺炎诊断，故病原体为肺炎链球菌（B对）。支原体肺炎（P49）（A错）以儿童和青年人居多，起病较缓慢，症状主要为乏力、咽痛、咳嗽、发热、肌痛、胸片显示肺部多种形态的浸润影。军团菌（C错）肺炎多见于老年人，可有高热、肌痛、相对缓脉，X线征象下叶斑片浸润，进展迅速，无空洞。金黄色葡萄球菌肺炎（P48）（D错）起病急、寒战、高热，外周血白细胞计数明显升高，可有肺实变体征，X线征象早期可出现肺叶实变、小叶浸润阴影，具有易变性等特征。肺结核（P65）（E错）临床表现为咳嗽、咳痰或咯血，并有长期午后潮热、乏力、盗汗及消瘦等结核中毒症状，白细胞一般不升高。